为了研究铅作业与工人尿铅含量的关系，随机抽查四种作业工人的尿铅含量。欲了解四种作业工人尿铅含量是否有差别，可选用哪种统计方法？
A. 完全随机设计方差分析
B. 配伍组设计方差分析
C. 2×4表的卡方检验
D. 每两组作t检验
E. 每两组作配对t检验

正确答案：A。完全随机设计方差分析